患者，女，70岁。冠心病史5年。今日突然心悸气短，不能平卧，咳嗽，咳粉红色泡沫样痰。应首先考虑的是
A. 肺癌
B. 肺脓肿
C. 肺结核
D. 急性肺水肿
E. 支气管扩张

正确答案：D。急性肺水肿

解析：患者老年女性，有冠心病史，突发心悸气短、不能平卧、咳粉红色泡沫痰，考虑为左心衰竭引起的急性肺水肿（D对）。肺癌主要表现为咳嗽、咳痰或咯血、气短或喘鸣、发作及体重减轻等（A错）。肺脓肿主要表现为咳大量脓臭痰（B错）。肺结核主要表现为乏力、低热、盗汗等结核分枝杆菌中毒症状（C错）。支气管扩张主要表现为反复的咳嗽、咳痰或咳脓痰（E错）。